阿托品用于治疗
A. 心源性休克
B. 过敏性休克
C. 失血性休克
D. 感染中毒性休克
E. 神经源性休克

正确答案：D。感染中毒性休克

解析：抗休克：大剂量阿托品能解除血管痉挛，舒张外周血管，改善微循环，可用于暴发型流行性脑脊髓膜炎、中毒性菌痢、中毒性肺炎等所致的感染性休克患者。掌握“阿托品”知识点。